古阿拉伯时期的重要文献是
A. 赫尔辛基宣言
B. 迈蒙尼提斯祷文
C. 希波克拉底誓言
D. 妙文集
E. 胡弗兰德十二箴言

正确答案：B。迈蒙尼提斯祷文

解析：古阿拉伯时期的重要医德文献是《迈蒙尼提斯祷文》（B对）。主要思想是为了世人的生命和健康，要时刻不忘医德，不要被贪欲、虚荣、名利所干扰而忘却为人类谋幸福的高尚目标。